具有消食化积，活血散瘀功效的药物是
A. 山楂
B. 莱菔子
C. 鸡内金
D. 麦芽
E. 谷芽

正确答案：A。山楂

解析：该题考查山楂的功效和主治。山楂味酸、甘，性微温，归脾、胃、肝经，具有消食化积，行气散瘀的功效。味以酸甘为主，则酸不过涩，甘不过缓，又具微温之性，可助行散之力，归脾胃之外的肝经，则能入肝经血分，能通行气血，有活血祛瘀止痛之功，此功效为常考点（A对）。